颈内动脉系与椎－基底动脉系的吻合支是
A. 脑桥动脉
B. 前交通动脉
C. 脉络丛前动脉
D. 后交通动脉
E. 大脑中动脉

正确答案：D。后交通动脉

解析：颈内动脉供应脑的主要分支为：大脑前动脉、大脑中动脉、脉络丛前动脉、后交通动脉。其中后交通动脉（D对）是颈内动脉系与椎－基底动脉系的吻合支。